可与奎尼丁发生与P-糖蛋白有关的相互作用的药物是
A. 华法林
B. 达比加群酯
C. 低分子肝素
D. 肝素钠
E. 维生素K

正确答案：B。达比加群酯

解析：本题考查药物的相互作用。达比加群酯（B对）可与奎尼丁发生与P糖蛋白有关的相互作用。达比加群酯为P-糖蛋白（P-gp） 载体的底物，奎尼丁为P-gp抑制剂，可增加达比加群酯的血药浓度，因此应用期间不能口服奎尼丁类药。华法林（A错）可竞争性拮抗维生素K的作用。低分子肝素（C错）用于预防深静脉血栓形成。肝素用药过量可出现自发性出血，对严重出血者可静脉注射硫酸鱼精蛋白注射液中和肝素钠（D错）。